某孕妇26岁第一胎，孕16周时开始在村卫生室检查，血色素84克/升，血压、宫高正常，胎心好，村医认为正常，足月时留在家分娩，产程＞30小时，产后大出血1500毫升以上，休克死亡，此产妇孕产期有无危险因素
A. 无
B. 1个
C. 2～4个
D. 5个
E. ＞5个

正确答案：E。＞5个

解析：本题考查孕中期保健。该孕妇有危险因素，且危险因素各为：孕16周时开始检查（检查延后）、在村卫生室检查、低血红蛋白、在家分娩、产程＞30小时、产后大出血等，危险因素＞5个（E对ABCD错）。